分子中有16（17）与αβ-γ-内酯环共轭的强心苷元，在UV光谱中的最大吸收是
A. 217～220nm
B. 270～278nm
C. 295～300nm
D. 300～ 330nm
E. 217～220nm，270nm

正确答案：E。217～220nm，270nm